女，38岁，10年前分娩后出现无乳，闭经，食欲减退，怕冷，面色苍白，毛发脱落。最可能的诊断是
A. 腺垂体功能减退症
B. 原发性甲状腺功能减退症
C. 神经性厌食症
D. 肾上腺皮质功能减退症
E. 卵巢功能早衰症

正确答案：A。腺垂体功能减退症

解析：年轻女性患者，10年前分娩后出现无乳，闭经，毛发脱落（性腺功能减退的临床表现），食欲减退，怕冷（甲状腺功能减退的临床表现），面色苍白（肾上腺功能减退的临床表现），最可能的诊断是腺垂体功能减退症（A对）。生育后妇女因产后腺垂体缺血性坏死引起腺垂体功能减退。原发性甲状腺功能减退症（B错）和肾上腺皮质功能减退症（D错）患者只会出本腺体功能减退的临床表现，不会出现其他腺体功能减退的表现。神经性厌食（C错）多见于年轻女性，有精神症状和恶病质，厌食消瘦、精神抑郁、性功能减退，闭经或月经稀少等，但无毛发脱落。卵巢功能早衰症（E错）（八版妇产科学P354）临床表现为继发性闭经，常伴围绝经期症状如月经周期改变、潮热出汗等，但较少见毛发脱落，无甲状腺及肾上腺功能减退的表现。